患儿，11岁。浮肿6天。症见眼睑水肿，小便短赤，下肢疮毒。查体：血压正常，舌红苔薄黄，脉滑数。实验室检查：镜下血尿，血清补体C₃明显下降。诊断为急性肾炎，其证型是
A. 风水相博
B. 湿热内侵
C. 变证水气上凌心肺
D. 变证邪陷厥阴
E. 变证水毒内闭

正确答案：B。湿热内侵

解析：湿热内侵肺脾，肺失通调，脾失健运，水失所主，故见颜面眼脸浮肿；湿热下注膀胱，故见小便短赤；下肢疮毒为发病诱因；舌红苔薄黄，脉滑数，为湿热之征，故其证候为湿热内侵证（B对）。风水相博证（A错）临床以头面眼睑浮肿为甚，伴风邪表证为特征。变证水气上凌心肺（C错）证临床以全身浮肿，咳嗽气急，烦躁不能平卧，唇甲发绀为临床特征。变证邪陷厥阴证（新版教材称为邪陷心肝证）（D错）临床以头痛眩晕，视物模糊，甚或神昏抽搐为临床特征。变证水毒内闭（E错）证临床以尿少或尿闭，头晕，头痛，恶心呕吐，嗜睡，甚或昏迷为临床特征。